苯二氮草类药物作用特点为
A. 对快动眼睡眠时相影响大
B. 没有抗惊厥作用
C. 没有抗焦虑作用
D. 无停药反跳
E. 可缩短睡眠诱导时间

正确答案：E。可缩短睡眠诱导时间